CD4分子主要表达在哪种细胞上
A. 辅助性T细胞
B. 细胞毒T细胞
C. NK细胞
D. B细胞
E. 中性粒细胞

正确答案：A。辅助性T细胞

解析：CD4+细胞是辅助性T细胞。掌握“白细胞分化抗原及黏附分子”知识点。